发作时心电图ST段抬高的是
A. 恶性型劳力性心绞痛
B. 变异型心绞痛
C. 初发型心绞痛
D. 稳定型心绞痛
E. 梗死后心绞痛

正确答案：B。变异型心绞痛

解析：变异型心绞痛（B对）是不稳定心绞痛的一种特殊类型，特征为静息心绞痛，发作时心电图表现为ST段抬高。梗死后心绞痛（E错）指急性心肌梗塞发生后一个月内又出现的心绞痛，与恶化型劳力性心绞痛（A错）和初发型心绞痛（C错）同属于不稳定型心绞痛（P229），发作时也可伴有一过性ST段（抬高或压低）和T波（低平或倒置）改变，故ST段抬高并非一定出现，综合比较，最佳答案为变异型心绞痛。稳定型心绞痛（D错）发作时由于心肌缺血心电图ST段压低，而不是抬高。